弥散性血管内凝血是一种
A. 独立疾病
B. 临床症候群
C. 病理过程
D. 体征
E. 症状

正确答案：C。病理过程

解析：弥散性血管内凝血是一种病理过程（C对ABDE错）。在某些致病因子的作用下，大量促凝物质入血，凝血因子和血小板被激活，使凝血酶增多，微循环中形成广泛的微血栓， 这一过程，凝血因子和血小板大量消耗，引起继发性纤维蛋白溶解功能增强，机体出现以止、凝血功能障碍为特征的病理过程。